肾病综合征的主要临床特征是
A. 少尿，浮肿，蛋白尿
B. 血尿，蛋白尿
C. 浮肿，蛋白尿，血尿，高血压
D. 血尿，少尿，蛋白尿，浮肿
E. 浮肿，大量蛋白尿，低蛋白血症

正确答案：E。浮肿，大量蛋白尿，低蛋白血症

解析：肾病综合征的临床特征为大量蛋白尿，低蛋白血症，水肿，高脂血症；其中“大量蛋白尿”和“低蛋白血症”是诊断肾病综合征的必备条件（E对）。肾病综合征会出现大量蛋白尿（A错）。肾病综合征的临床特征为大量蛋白尿，低蛋白血症，水肿，高脂血症，血尿常为急性肾小球肾炎起病的首发症状，几乎所有患者都有血尿（B错）。浮肿，蛋白尿，血尿，高血压是急性肾小球肾炎的临床特征（C错）。肾病综合征的临床表现为大量蛋白尿，低蛋白血症，水肿，高脂血症（D错）。